热者寒之属于
A. 正治法
B. 反治法
C. 治标法
D. 从治法
E. 治本法

正确答案：A。正治法

解析：正治法指采用与证候性质相反的方药进行治疗的治则，热者寒之即以寒治热（A对）。反治法指顺从病证的外在假象而治的治则，由于采用的方药性质与病证中假象的性质相同，故又称为“从治”（BD错）。治标法指“标”危急，先采用治标的原则（C错）；治本法指标症不急时，针对本病治疗（E错）。